属两性离子型表面活性剂的是
A. 卵磷脂
B. 月桂醇硫酸钠
C. 聚山梨酯80
D. 新洁尔灭
E. 脱水山梨醇单硬脂酸脂

正确答案：A。卵磷脂

解析：本题考查的是表面活性剂的类型。卵磷脂属两性离子型表面活性剂的是卵磷脂（A对）。表面活性剂按其解离情况不同分为离子型和非离子型两大类，其中离子型表面活性剂又分为阴离子型、阳离子型和两性离子型表面活性剂三类。（1）阴离子型表面活性剂：本类表面活性剂起表面活性作用的是阴离子。主要包括高级脂肪酸盐、硫酸化物以及磺酸化物。①高级脂肪酸盐：又称肥皂类。②硫酸化物：为硫酸化油和高级脂肪醇的硫酸酯类。常用的有：a.硫酸化蓖麻油，俗称土耳其红油；b.高级脂肪醇硫酸酯类，如有十二烷基硫酸钠（又称月桂醇硫酸钠（B错））。③磺酸化物：主要有脂肪族磺酸化物、烷基芳基磺酸化物、烷基萘磺酸化物等。常用的有：a.脂肪族磺酸化物，如二辛基琥珀酸磺酸钠（商品名“阿洛索-OT”）等；b.烷基芳基磺酸化物，如十二烷基苯磺酸钠。（2）阳离子型表面活性剂：本类表面活性剂分子结构中起表面活性作用的是阳离子，即分子结构中含有一个五价的氮原子，又称季铵化物。常用的有苯扎氯铵（洁尔灭）、苯扎溴铵（新洁尔灭（D错））等。（3）两性离子型表面活性剂：本类表面活性剂的分子结构中同时含有阴阳离子基团，在不同pH介质中可表现出阴离子或阳离子表面活性剂的性质。①天然的两性离子表面活性剂：主要有豆磷脂和卵磷脂。②合成的两性离子表面活性剂：本类表面活性剂的阴离子部分主要是羧酸盐，阳离子部分主要是胺盐或季铵盐。（4）非离子型表面活性剂：本类表面活性剂在水中不解离，其分子结构中亲水基团多为甘油、聚乙二醇和山梨醇等多元醇，亲油基团多为长链脂肪酸或长链脂肪醇以及烷基或芳基等，以酯键或醚键相结合。①脱水山梨醇脂肪酸酯：本类表面活性剂系由山梨醇与不同的脂肪酸组成的酯类化合物，商品名为司盘类。根据所结合的脂肪酸种类和数量的不同，本类表面活性剂有以下常用品种：脱水山梨醇单月桂酸酯（司盘20）、脱水山梨醇单棕榈酸酯（司盘40）、脱水山梨醇单硬脂酸酯（E错）（司盘60）、脱水山梨醇单油酸酯（司盘80）、脱水山梨醇三油酸酯（司盘85）等。②聚氧乙烯脱水山梨醇脂肪酸酯：又称为聚山梨酯，本类表面活性剂是在司盘类表面活性剂分子结构的剩余羟基上，结合聚氧乙烯基而成的醚类化合物，商品为吐温类。根据所结合的脂肪酸种类和数量的不同，本类表面活性剂常用的有：聚山梨酯20（吐温20）、聚山梨酯40（吐温40）、聚山梨酯60（吐温60）、聚山梨酯80（C错）（吐温80）、聚山梨酯85（吐温85）等。③聚氧乙烯脂肪酸酯：本类表面活性剂系由聚乙二醇与长链脂肪酸缩合而成，商品有卖泽。常用的有聚氧乙烯40硬脂酸酯。④聚氧乙烯脂肪醇醚：本类表面活性剂是由聚乙二醇与脂肪醇缩合而成的醚类，商品有苄泽。因聚氧乙烯聚合度和脂肪醇的不同而有不同的品种，常用的有西土马哥、平平加O及埃莫尔弗等。⑤聚氧乙烯聚氧丙烯共聚物：本类表面活性剂是由聚氧乙烯和聚氧丙烯聚合而成。常用的有普朗尼克类，如普朗尼克F-68。